男性，30岁。全身乏力，低热伴左上腹肿块半年。肝肋下2cm，脾肋下7cm，化验：血红蛋白80g/L，白细胞140×10⁹/L，血小板100×10⁹/L，骨髓象原始粒细胞0.02，Ph染色体阳性，正确的治疗为
A. 大剂量抗生素抗感染
B. 脾切除
C. HOAP方案化疗
D. 羟基脲口服
E. VAP方案化疗

正确答案：D。羟基脲口服

解析：患者青年男性，全身乏力，低热（慢性粒细胞白血病慢性期可有乏力、低热等症状），伴左上腹肿块半年（慢性病程），查体肝肋下2cm，脾肋下7cm（慢性粒细胞白血病常有肝、脾肿大，脾脏肿大为最显著的体征），化验：血红蛋白80g/L（成年男性Hb正常值120～160g／L），提示贫血，白细胞140×10⁹/L（正常4～10×10⁹／L）明显升高，提示高白细胞血症，血小板100×10⁹/L（正常100～300×10⁹/L）尚正常，骨髓象原始粒细胞0.02（慢粒患者骨髓原始细胞＜10%），Ph染色体阳性（95%以上的慢粒患者可出现Ph染色体，是慢粒的特征性遗传学变化），故患者考虑为慢性粒细胞白血病且合并有高白细胞血症，此时应给予羟基脲口服（D对）治疗，降低白细胞，然后给予分子靶向药物伊马替尼治疗。大剂量抗生素抗感染（A错）、脾切除（B错）不是慢性粒细胞白血病的治疗方法；HOAP方案（C错）为原急非淋的化疗方案；VAP方案化疗（E错）为原急淋的化疗方案。